休克初期发生的急性肾功能衰竭属
A. 肾前性肾功能衰竭
B. 肾后性肾功能衰竭
C. 肾性肾功能衰竭
D. 肾前性和肾性肾功能衰竭
E. 器质性肾功能衰竭

正确答案：A。肾前性肾功能衰竭

解析：休克早期交感神经强烈兴奋及缩血管物质的大量释放，既可引起皮肤、腹腔内脏及肾脏等许多器官缺血缺氧，也具有重要的代偿意义。急性肾衰(ARF)可分为肾前性、肾后性和肾性。肾脏本身的疾病和损伤，称肾性肾衰（C错）。肾前性肾衰常常由于心力衰竭或其他原因引起血压下降、肾灌注不足引起的，休克初期发生的急性肾功能衰竭属肾前性肾功能衰竭（A对DE错）。肾后性肾衰（B错）的主要原因是尿路梗阻和尿液返流等。